患者，男，26岁，诊断为感染性心内膜炎。静滴青霉素约3分钟出现胸闷、呼吸困难、脉搏频弱、血压下降、意识不清等过敏性休克症状。首选的抢救药物是
A. 口服甲硝唑
B. 肌注肾上腺素
C. 静注地塞米松
D. 口服维生素B₆
E. 肌注维生素K₁

正确答案：B。肌注肾上腺素

解析：本题考查青霉素的不良反应。青霉素类用药后可发生严重的过敏反应，如过敏性休克（Ⅰ型变态反应）。此反应一旦发生，必须就地抢救，立即给患者肌内注射0.1%肾上腺素（B对）0.5～1ml， 必要时以5%葡萄糖注射液或氯化钠注射液稀释后做静脉注射。